侧舌隆突来自于
A. 中鼻突
B. 下颌突
C. 鼻额突
D. 侧鼻突
E. 球状突

正确答案：B。下颌突

解析：本题考查舌的发育。侧舌隆突来自于下颌突（B对）。约在胚胎第3周末、4周初，两侧第一、第二鳃弓在中线处联合。此时，在下颌突的原始口腔侧，内部的间充质不断增生，形成3个膨隆的突起。其中两侧两个对称的隆起体积较大，称侧舌隆突。  胚胎第3周，发育中的前脑生长迅速，其下端出现了一个突起称额鼻突（C错），此时由于迁移的神经嵴细胞的增生，在额鼻突两侧的下方出现第一鳃弓。约在胚胎24天，第一鳃弓上出现另一个突起即上颌突。此时的原口界限是上有迅速增大的额鼻突、下有第一鳃弓（此时称下颌突）（B错） ，两侧为上颌突。在胚胎第4周末，额鼻突的末端两侧的外胚层上皮出现椭圆形局部增厚区，称嗅板或鼻板。鼻板由于细胞的增生,边缘隆起，特别是在其外侧缘，隆起更明显，使鼻板中央凹陷，称嗅窝或鼻凹。这样，嗅窝将额鼻突分成3个突起：两个嗅窝之间的突起称中鼻突（A错）；嗅窝两侧的2个突起称侧鼻突（D错）。